患者心悸，气短1年，劳累后加重。检查：脉搏80次／分，节律不规整，心率约110次／分，心律完全不规则，心音强弱绝对不一致。此患者心律失常的类型是
A. 窦性心律不齐
B. 窦性心动过速
C. 过早搏动
D. 心房纤维颤动
E. 室上性心动过速

正确答案：D。心房纤维颤动

解析：患者心率完全不规则，心音强弱绝对不一致，脉搏80次/分，心率110次/分，脉率少于心率，为脉搏短绌，故判断该患者为心房纤维颤动(D对)。部分青少年可出现随呼吸改变的心律，吸气时心率增快，呼气时减慢，称为窦性心律不齐（A错）。窦性心动过速心率多为100次/分-150次/分，大多心音有力，或伴有出汗、头昏、眼花、乏力等症状（B错）。早搏是指在规则心律基础上，突然提前出现一次心跳，其后有一较长间歇。如果期前收缩规律出现，可形成联律（C错）。室上性心动过速心率快，多在150-250次/分，节律规则，心音绝对规则一致（E错）。